影响药物溶解度的因素有
A. 药物的极性
B. 溶剂
C. 温度
D. 同离子效应
E. 药物的晶形

正确答案：A、B、C、D、E。药物的极性；溶剂；温度；同离子效应；药物的晶形

解析：本题考查影响药物溶解度的因素。影响药物溶解度的因素：（1）药物分子结构（A对）与溶剂（B对）；（2）温度（C对）；（3）药物的晶型（E对）；（4）粒子大小；（5）加入第三种物质。溶液中加入溶剂、药物以外的其他物质可能改变药物的溶解度，如加入助溶剂、增溶剂可以增加药物的溶解度，加入某些电解质可能因同离子效应（D对）而降低药物的溶解度，例如许多盐酸盐药物在0.9%氯化钠溶液中的溶解度比在水中低。